下列各项，在五输穴中属“水”的是
A. 少府
B. 大陵
C. 后溪
D. 曲泉
E. 经渠

正确答案：D。曲泉

解析：曲泉（D对）为肝经合穴属水，少府（A错）为心经荥穴属火，大陵（B错）为心包经书穴属土，后溪（C错）为小肠经输穴属木，经渠（E错）为肺经经穴属金。